美国弗明汉地区，通过对一批人的长期随访观察，研究心血管病及其影响因素，该研究采用的流行病学研究方法是
A. 现况研究
B. 队列研究
C. 病例对照研究
D. 生态学研究
E. 现场试验

正确答案：B。队列研究

解析：本题考查对流行病学发展史。美国弗明汉地区，通过对一批人的长期随访观察，研究心血管病及其影响因素，该研究采用的流行病学研究方法是队列研究（B对ACDE错）。